导致急性心肌梗死患者早期（24小时内）死亡的主要原因为
A. 心力衰竭
B. 心源性休克
C. 心律失常
D. 心脏破裂
E. 肺栓塞

正确答案：C。心律失常

解析：心律失常（C对）为急性心肌梗死常见的症状，多发生在24小时内。其中最常见的心律失常为室性期前收缩，如室性期前收缩频发、成对出现或呈短阵室性心动过速，多源性或落在前一心搏的易损期时（R在T波上），随之可发生室颤，导致病人立即死亡。急性心肌梗死伴心力衰竭（A错）多在最初几天内发生，为梗死后心脏舒缩力显著减弱或不协调所致，一般不会在早期（24小时内）即导致患者死亡。心源性休克（B错）多在起病后数小时至数日内发生，见于约20%的患者，也并非急性心肌梗死患者早期死亡的主要原因。心脏破裂（D错）和肺栓塞（E错）都为心肌梗死后并发症，其中心脏破裂较少见，常在起病1周内出现；肺栓塞可因下肢静脉血栓部分脱落所致，大块肺栓塞可导致猝死，但多见于起病后1～2周（P240），两者都不会在早期（24小时内）内引起病人死亡。